HBV是一种耐热的病毒，在95℃时要几分钟才能将其杀灭
A. 1分钟
B. 2分钟
C. 5分钟
D. 10分钟
E. 15分钟

正确答案：C。5分钟

解析：本题考查乙型肝炎。乙型（病毒性）肝炎（简称乙肝）由乙肝病毒（HBV）感染引起，是一种传播广泛、严重危害人类健康的传染病，是导致急慢性肝炎、肝硬化和肝癌的主要原因。HBV是一种耐热的病毒，在95℃时要5分钟（C对）才能将其杀灭。